不符合室性期前收缩的心电图表现是
A. 提前出现宽大畸形的QRS波
B. T波方向与QRS主波方向相反
C. 代偿间歇完全
D. 联律间期恒定
E. QRS波群前出现倒置的P波

正确答案：E。QRS波群前出现倒置的P波

解析：室性期前收缩是指希氏束分叉以下部位过早发生的，提前使心室除极的心搏。提前出现宽大畸形的QRS波（A对）是室早的心电图特点。室性期前收缩与其前面的窦性搏动之间期（即联律间期）恒定（D对）。室性期前收缩不干扰窦房结冲动发放节律，所以室性期前收缩后出现完全性代偿间歇（C对）。心电图T波低平，尤其是伴随ST-T段改变常见于冠心病、高血压、心肌病、电解质紊乱、药物影响等情况，室性早搏ST段和T波方向与QRS主波方向相反（B对），即若室早QRS主波方向向上，则ST段下移，T波倒置，而室早QRS主波方向向下时，则ST段上移，T波直立。